对溴新斯的明描述错误的是
A. 具有季铵盐结构
B. 口服后在肠内被部分破坏
C. 尿液中可检出两个代谢产物
D. 口服剂量应远大于注射剂量
E. 以原型药物从尿中排出

正确答案：E。以原型药物从尿中排出